正在接受根管治疗，但根尖周损害还在加重则应考虑可能感染了以下哪种细菌
A. 放线菌
B. 梭形杆菌
C. 消化链球菌
D. 产黑色素普氏菌
E. 真杆菌

正确答案：A。放线菌

解析：本题考查牙髓根尖周病各感染部位中的主要细菌-感染根管。正在接受根管治疗，但根尖周损害还在加重则应考虑可能感染了放线菌（A对）。梭形杆菌、消化链球菌、真杆菌是感染根管中较常见的优势菌（B错），其中消化链球菌、真杆菌与根尖部出现疼痛、肿胀、叩痛和窦道形成有关（CE错）。产黑色素普氏菌与急性根尖周炎症和根管内恶臭关系密切（D错）。